我国现行的《职业性慢性铅中毒的诊断》（GBZ37-2015）规定中，慢性铅中毒的诊断分期包括
A. 三种
B. 四种
C. 五种
D. 六种
E. 七种

正确答案：A。三种